ADME分别对应于
A. 吸收、分布、代谢和排泄
B. 吸收、代谢、分布和排泄
C. 排泄、吸收、代谢和分布
D. 分布、代谢、吸收和排泄

正确答案：A。吸收、分布、代谢和排泄

解析：本题考查ADME过程。ADME分别对应于吸收、分布、代谢和排泄（A对BCD错）四个过程。